心室肌的后负荷指
A. 舒张末期容积
B. 射血期心室内压
C. 等容收缩期心室内压
D. 大动脉血压
E. 右心房压力

正确答案：D。大动脉血压